青少年牙周炎的牙周维护间隔时间，初期应
A. 1～2个月
B. 4～6个月
C. 6～8个月
D. 8～10个月
E. 6～12个月

正确答案：A。1～2个月

解析：本题考查侵袭性牙周炎治疗后的定期维护。侵袭性牙周炎治疗后容易复发疗效能否长期保持取决于患者自我控制菌斑的依从性和维护治疗的措施，定期的维护治疗是关键，开始约为每1～2个月（A对）一次，6个月若病情稳定可逐渐延长。